治疗实水一身悉肿，腹胀喘满，二便不利，脉沉有力。应首选
A. 十枣汤
B. 五苓散
C. 实脾散
D. 五皮散
E. 真武汤

正确答案：A。十枣汤

解析：十枣汤证系水饮壅盛，停聚于里，内外泛滥所致。水饮泛溢肢体，则一身悉肿；阻滞胸腹，气机壅塞，则腹胀喘满。此水饮壅盛之实证，治当遵循“留者攻之”、“有水可下之”的原则，宜攻逐水饮，用十枣汤治疗（A对）。五苓散（B错）的功用为利水渗湿，温阳化气，主治蓄水证；痰饮；水湿内停证。实脾散（C错）的功用为温阳健脾，行气利水，主治脾肾阳虚，水气内停之阴水。五皮散（D错）的功用为利水消肿，理气健脾，主治水停气滞之皮水证。真武汤（E错）的功用为温阳利水，主治阳虚水泛证。